患者壮热面赤，汗出恶热，烦渴引饮脉洪大有力。治疗应首选
A. 黄连解毒汤
B. 竹叶石膏汤
C. 白虎汤
D. 麻黄杏仁甘草石膏汤
E. 大承气汤

正确答案：C。白虎汤

解析：患者壮热面赤，汗出恶热，烦渴引饮脉洪大有力。方用白虎汤为治疗阳明经热、气分热盛证的基础方。石膏功善清解，透热出表，以除阳明气分之热；知母滋阴润燥；粳米、炙甘草益胃生津（C对）。黄连解毒汤方证乃火毒充斥三焦所致。为清热解毒的基础方（A错）。竹叶石膏汤方证乃热病后期，余热未清，气津两伤，胃气不和所致。为治疗热病后期，余热未清，气津耗伤的常用方（B错）。麻黄杏仁甘草石膏汤方证是表邪入里化热，壅遏于肺，肺失宣降所致。为治疗表邪未解，邪热壅肺之喘咳的基础方（C错）。大承气汤为治疗阳明腑实证的基础方，又是寒下法的代表方（E错）。